与胆汁酸结合而降血脂的药物是
A. 氯贝丁酯
B. 洛伐他汀
C. 考来烯胺
D. 烟酸
E. 普罗布考

正确答案：C。考来烯胺

解析：本题考查调血脂药。考来烯胺（C对）为胆酸螯合剂，通过与胆酸结合阻断胆固醇重吸收。氯贝丁酯（A错）通过抑制血小板聚集降血脂。洛伐他汀（B错）为HMG-CoA还原酶抑制剂。烟酸（D错）调节血脂可能与抑制脂肪组织脂解和减少肝脏中胆固醇合成和分泌有关。普罗布考（E错）通过渗入到脂蛋白颗粒中影响脂蛋白代谢，抑制氧化LDL-C的生成而产生降血脂作用。